《药品经营质量管理规范》应是执业药师或有药师以上专业技术职称的是
A. 药品零售企业主要负责人
B. 药品零售企业专职质量管理人员
C. 药品零售企业中处方审核人员
D. 药品零售企业质量负责人
E. 药品零售企业法定代表人

正确答案：C。药品零售企业中处方审核人员

解析：本题考查处方审核人员。《药品经营质量管理规范》应是执业药师或有药师以上专业技术职称的是药品零售企业中处方审核人员（C对）。《药品经营质量管理规范》规定，企业应当按照国家有关规定配备执业药师，负责处方审核，指导合理用药。